X线片的读片内容为
A. 冠根比例
B. 牙周膜的宽度
C. 不良充填体
D. 牙槽骨的破坏形式
E. 以上均是

正确答案：E。以上均是

解析：本题考查X线片的读片内容。X线片可以显示整个牙冠、牙根、牙槽骨、牙周膜，牙冠、牙根密度较高，且以牙颈部为界，可以测量牙冠牙根的长度，计算冠根比例（A对）。牙周膜显示为围绕牙根的窄黑线，可以测量其宽度（B对）。不良充填体（C对）在X线片上会显示出其异常表现，如悬突、缝隙、继发龋等。牙槽骨吸收破坏后，密度会降低，根据X线片上阴影的位置、大小、形状可确定是垂直性吸收还是水平性吸收（D对）。（ABCD均对，故E为本题的正确答案）。